假性神经递质引起意识障碍的机制是
A. 取代乙酰胆碱
B. 取代谷氨酰胺
C. 取代去甲肾上腺素
D. 取代r-氨基丁酸
E. 取代多巴

正确答案：C。取代去甲肾上腺素

解析：肝功能严重障碍时，假性神经递质增多，可取代去甲肾上腺素（C对）和多巴胺（E错）被神经元摄取，并贮存在突触小体的埏泡中。但其被释放后的生理效应则远较去甲肾上腺素和多巴胺弱，脑干网状结构上行激动系统的唤醒功能不能维持，从而发生昏迷。